免疫球蛋白
A. 水解乙酰胆碱
B. 抑制凝血酶
C. 特异地与球蛋白结合
D. 专与血红素结合
E. 属抗体

正确答案：E。属抗体